脑脊液产生的部位是
A. 上矢状窦
B. 脉络组织
C. 脉络丛
D. 脑蛛网膜粒
E. 脉络膜

正确答案：C。脉络丛

解析：脑脊液主要由脑室脉络丛（C对）产生。